佝偻病活动期X线表现
A. 干骺端增厚，钙化预备带消失，呈毛刷样杯口状改变
B. 钙化预备带重新出现，致密增厚
C. 骨骼无明显改变
D. 长骨短曲和弯曲，干骺端变宽，呈喇叭口状，轮廓光整
E. 长骨钙化预备带密度增加，骨皮质增厚及骨硬化

正确答案：A。干骺端增厚，钙化预备带消失，呈毛刷样杯口状改变

解析：本题考查维生素D缺乏性佝偻病活动期X线表现。维生素D缺乏性佝偻病活动期X线表现为干骺端增厚，钙化预备带消失，呈毛刷样杯口状改变（A对BCDE错）。